患者，女，70岁。冠心病史5年。今日突然心悸气短，不能平卧，咳嗽，咯粉红色泡沫样痰。应首先考虑的是
A. 肺癌
B. 肺脓肿
C. 肺结核
D. 急性肺水肿
E. 支气管扩张

正确答案：D。急性肺水肿

解析：本例患者为老年女性，有长期冠心病的病史，突发心悸、气短、咳嗽、咯粉红色泡沫样痰，且不能平卧，诊断首先考虑的是急性左心衰伴急性肺水肿（D对）。肺癌（A错）好发于吸烟的老年患者，临床表现主要为长期刺激性干咳和持续性痰中带血。肺脓肿（B错）病人临床表现为高热、咳嗽和咳大量脓臭痰。肺结核（C错）病人临床表现主要为长期午后潮热、盗汗、咳嗽、咳痰。支气管扩张（E错）病人临床表现主要为慢性咳嗽、咯大量脓痰和（或）反复咯血。